以下为左氧氟沙星的部分报告书，合格的项目有
A. 紫外光谱
B. 杂质A
C. 其它杂质
D. 其它总杂
E. 含量测定

正确答案：A、B、C。紫外光谱；杂质A；其它杂质

解析：本题考查药品检验报告书。紫外色谱（A对）、杂质A（B对）、其它杂质（C对）的检验结果都在标准范围内，小于等于正常值；其它总杂（D错）的检验结果是0.8%，超出了正常值标准；含量测定（E错）结果是110.1%，超过正常值标准。